玄麦甘桔含片的功能是
A. 清热滋阴，祛痰利咽
B. 清热解毒，敛疮止痛
C. 清热利咽，解毒止痛
D. 清热解毒，消肿利咽
E. 清热利咽，生津润燥

正确答案：A。清热滋阴，祛痰利咽

解析：本题考查的是玄麦甘桔含片的功能。玄麦甘桔含片的功能是清热滋阴，祛痰利咽（A对）。玄麦甘桔含片：【功能】清热滋阴，祛痰利咽。小儿咽扁颗粒：【功能】清热利咽，解毒止痛（C错）。六神丸：【功能】清热解毒，消肿利咽（D错），化腐止痛。清音丸：【功能】清热利咽，生津润燥（E错）。功能为清热解毒，敛疮止痛（B错）的中成药，2022年考试指南未明确说明。